用于治疗播散性淋病，临用前需用0.9%苯甲醇稀释的药物是
A. 克拉霉素
B. 替考拉宁
C. 美罗培南
D. 大观霉素
E. 氯霉素

正确答案：D。大观霉素

解析：本题考查药物的使用。大观霉素（D对）在进行深部肌内注射时，临用前，每2g本品加入0.9%苯甲醇注射液3.2ml，振摇，使呈混悬液。克拉霉素（A错）为大环内酯类抗菌药物，可与PPI、铋剂合用治疗幽门螺杆菌引起的胃溃疡。替考拉宁（B错）为多肽类抗菌药物，用于各种革兰阳性菌感染。美罗培南（C错）为β内酰胺类抗菌药物，用于由单一或多种敏感细菌引起的成人及儿童的肺炎（医院获得性肺炎）、尿路感染、腹腔内感染等病。氯霉素（E错）为酰胺醇类抗菌药物，用于治疗某些严重感染，是敏感菌株所致伤寒、副伤寒的选用药物。